引起心室舒张功能异常因素中，下列哪项错误
A. Ca2+-ATP酶活性下降
B. Ca2+复位加速
C. 心肌能量缺乏
D. 心室顺应性下降
E. 心室僵硬度增大

正确答案：B。Ca2+复位加速

解析：肥大和衰竭心肌细胞由于缺血缺氧，能量缺乏（C对），肌质网或心肌细胞膜上Ca2+-ATP酶活性下降（A对），使心肌收缩后胞质内Ca2+不能被肌浆网摄取或转运至胞外，导致Ca2+复位迟缓（B错，为本题正确答案），心室舒张减慢、不完全，此种情况称为主动性舒张功能减弱。高血压、肥厚性心肌病时发生的室壁增厚、纤维化等改变使心室顺应性下降（D对）即心室僵硬度增大（E对），心室舒张末期容量减少，此种情况称为心室被动性舒张功能减弱。